与耐药性的获得及转移密切相关的细菌结构是
A. 荚膜
B. 质粒
C. 普通菌毛
D. 芽孢
E. 鞭毛

正确答案：B。质粒

解析：与耐药性的获得及转移密切相关的细菌结构有染色体DNA、质粒（B对）、转座子等。荚膜（A错）是细菌致病重要的毒力因子。普通菌毛（C错）是细菌的黏附结构，与细菌的致病性相关。芽孢（D错）是细菌的休眠形式，是某些外源性感染的重要来源。鞭毛（E错）是细菌的运动器官，与细菌致病性有关。